男，45岁。2周前烧伤，烧伤面积40%左右。近五天开始发热，体温38-39℃，间歇性，逐渐加重并伴有寒战。血培养出的细菌可产生凝固酶、杀白细胞素、肠毒素。最可能感染的细菌是
A. 肺炎链球菌
B. 溶血性链球菌
C. 厌氧芽孢菌
D. 大肠杆菌
E. 金黄色葡萄球菌

正确答案：E。金黄色葡萄球菌

解析：45岁男性患者，烧伤后出现间歇性高热、逐渐加重并伴寒战，考虑为细菌感染，血培养出细菌可产生凝固酶、杀白细胞素、肠毒素，都是金黄色葡萄球菌的致病物质，因此最可能感染的细菌是金黄色葡萄球菌（E对），金黄色葡萄球菌可引起皮肤的化脓性感染以及全身感染，其致病物质主要为凝固酶和其他酶类、毒素细胞溶素、杀白细胞素、表皮脱落素、毒性休克综合征毒素-1、肠毒素等（P93表8-2）。